患者经血非时而下，出血量时多时少，时出时止已月余，经色紫暗，有血块，小腹疼痛，舌质紫暗，边有瘀点，脉弦涩。治疗应首选的方剂是
A. 逐瘀止血汤
B. 桃红四物汤
C. 失笑散
D. 少腹逐瘀汤
E. 血府逐瘀汤

正确答案：A。逐瘀止血汤

解析：患者经血非时而下，出血量时多时少，时出时止已月余为崩漏的表现，经色紫暗，有血块，小腹疼痛，舌质紫暗，边有瘀点，脉弦涩，是血瘀证的表现，治以活血化瘀，固冲止血，选方逐瘀止血汤（A对）。桃红四物汤养血活血，主治血虚兼血瘀证（B错）。失笑散活血祛瘀，散结止痛（C错）。少腹逐瘀汤活血祛瘀，温经止痛（D错）。血府逐瘀汤活血祛瘀，行气止痛，主治胸中血瘀证（E错）。